颞下颌关节区检查的内容不包括
A. 颞下颌关节弹响的检查
B. 咀嚼肌肉的扪诊
C. 颞下颌关节活动度的检查
D. 外耳道前壁的检查
E. 开口度及开口型

正确答案：B。咀嚼肌肉的扪诊

解析：本题考查修复学临床检查。颞下颌关节区检查的内容不包括咀嚼肌肉的扪诊（B错，为本题正确答案）。咀嚼肌检查同颞下颌关节区的检查和颌面部检查同属于口腔外部检查。颞下颌关节区检查：（1）颞下颌关节的活动度（C对）；（2）颞下颌关节弹响（A对）；（3）外耳道前壁（D对）；（4）开口度及开口型（E对）；（5）下颌侧（牙合）运动。